男，45岁。发热3天，少尿1天，于12月15日入院。查体：BP60/30mmHg，神志清，球结膜充血、水肿，双腋下有出血点，实验室检查：WBC25×10⁹/L，plt50×10⁹/L，尿蛋白（+++）。最可能的诊断是
A. 立克次体病
B. 急性肾炎
C. 肾综合征出血热
D. 流行性感冒
E. 钩端螺旋体病

正确答案：C。肾综合征出血热

解析：45岁男性，发热3天（肾综合征出血热发热期全身中毒症状），少尿1天（肾综合征出血热少尿期），于12月15日入院（肾综合征出血热高发季节）；查体：BP60/30mmHg（血压低），神志清，球结膜充血、水肿，双腋下有出血点（毛细血管损害征），实验室检查：WBC25×10⁹/L（成人正常参考值4～10×10⁹/L），plt50×10⁹/L（100～300×10⁹/L），尿蛋白（+++）（肾损害），根据患者的临床表现和实验室结果，最可能的诊断是肾综合征出血热（C对），本病的主要变化是全身小血管和毛细血管广泛性损害，临床上以发热、低血压休克、充血出血和肾损害为主要表现。急性肾炎（B错）可有发热、尿少，但不会出现球结膜水肿，出血，胸背部条索点状瘀点（八版内科学P469）。流行性感冒（D错）典型的临床特点是急起高热、显著乏力，全身肌肉酸痛，以及鼻塞、流涕和喷嚏等相对较轻的上呼吸卡他症状，秋冬季节高发，很少出现出血点及低血压。钩端螺旋体病（E错）常表现为发热、酸痛、全身软、眼红、腿痛、淋巴结肿大，有明显的腓肠肌疼痛，外周血白细胞总数和中性粒细胞轻度增高或正常（P253）。